治疗持续状态的首选药是
A. 扑米酮
B. 苯妥英钠
C. 地西泮（静脉注射）
D. 乙琥胺
E. 卡马西平

正确答案：C。地西泮（静脉注射）

解析：本题考查地西泮。地西泮（C对）主要为GABA受体激动剂，也可作用于Na⁺通道，加强突出前抑制，抑制皮质、丘脑和边缘系统的病灶异常放电向周围脑组织的扩散，起抗惊厥作用，但不能消除病灶的异常放电。地西泮静注为癫痫持续状态治疗的首选药。抗癫痫药扑米酮（A错）主要用于使用其它抗癫痫药无效的癫痫大发作、精神运动性发作。苯妥英钠（B错）的抗癫痫作用机制是通过减少钠离子内流而使神经细胞膜稳定，限制Na⁺通道介导的发作性放电的扩散，为大发作和局限性发作的首选。乙琥胺（D错）为癫痫小发作首选。卡马西平（E错）首选用于癫痫大发作和部分性发作。